对单纯的餐后血糖高，而空腹和餐前血糖水平不高的2型糖尿病者应首选
A. 格列本脲
B. 二甲双胍
C. 罗格列酮
D. 精蛋白锌胰岛素
E. 阿卡波糖

正确答案：E。阿卡波糖

解析：本题考查降糖药。阿卡波糖（E对）是单纯餐后血糖高，而空腹和餐前血糖不高的糖尿病首选治疗药物。格列本脲（A错）在2型非肥胖型糖尿病患者有良好的胰岛β细胞储备功能、无高胰岛素血症时应用。二甲双胍（B错）是治疗2型肥胖型糖尿病患者的首选。罗格列酮（C错）是餐后血糖升高为主，伴餐前血糖轻度升高的首选。精蛋白锌胰岛素（D错）用于治疗对低血糖耐受力差的老年人。